患者，女，40岁。带下量多，色黄或白，质黏稠，有臭气，小腹作痛，或阴痒,便秘溺赤，舌红苔黄厚腻，脉滑数。治疗应首选
A. 五味消毒饮
B. 龙胆泻肝汤
C. 萆蘚渗湿汤
D. 止带方
E. 易黄汤

正确答案：D。止带方

解析：患者以”带下量多“为主症，且伴有”色黄或白，质黏稠，有臭气，小腹作痛，或阴痒,便秘溺赤，舌红苔黄厚腻，脉滑数“可诊断为湿热下注证，治疗时应清利湿热，解毒杀虫，可选用止带方（D对）。味消毒饮的功效为清热解毒，利水除湿，为带下过多热毒蕴结证的首选（A错）。龙胆泻肝汤的功效为清泻肝胆实火或清泻肝经湿热，治疗肝胆实火上炎证或肝经湿热下注证（B错）。萆薢胜湿汤的功效为健脾利湿，清热解毒，治疗湿毒瘀结证（C错）。易黄汤的功效为健脾祛湿，清热止带，治疗脾虚湿蕴化热证（E错）。